女性，26岁。被人发现时躺在公园一角落呈半昏迷状态。查体：神志不清，两瞳孔针尖样大小，口角流涎，口唇紫绀，两肺满布水泡音，心率60次/分，肌肉有震颤。应首先考虑的是
A. 癫痫大发作
B. 严重心律失常
C. 左心功能衰竭
D. 有机磷农药中毒
E. 安眠药中毒

正确答案：D。有机磷农药中毒

解析：患者女性，呈半昏迷状态，神志不清（有机磷中毒引起的中枢神经系统症状），查体见两瞳孔针尖样大小，口角流涎，两肺满布水泡音（副交感神经过度兴奋引起的M样症状），口唇紫绀（提示缺氧），心率正常，肌肉有震颤（乙酰胆碱蓄积过多引起的N样症状），综合患者的病史、体查，应首先考虑的是有机磷农药中毒（D对）。癫痫大发作（A错）即全面强直-阵挛发作（八版神经病学P303），主要临床特征为意识丧失、双侧强直后出现阵挛，发作多后能自行恢复。严重心律失常（B错）（如室扑室颤、三度房室传导阻滞等）能引发意识突然丧失，患者主要表现为局部或全身抽搐、呼吸停止、面色苍白、瞳孔散大等（P330）。左心功能衰竭（175）（C错）病情严重时可致昏迷，查体肺部有湿啰音，但患者常有血压下降、心尖部第一心音减弱、心率增快等表现。安眠药中毒（E错）属镇静催眠药中毒（P905），急性中毒时主要表现为意识障碍，呼吸抑制及血压下降，患者曾有服用大量镇静催眠药史。